下列粉尘何者为无机粉尘
A. 农药粉尘
B. 橡胶粉尘
C. 水泥粉尘
D. 木尘
E. 谷物粉尘

正确答案：C。水泥粉尘

解析：本题考查的是生产性粉尘的分类。生产性粉尘分为无机粉尘，有机粉尘和混合性粉尘。无机粉尘则包括矿物性粉尘，金属性粉尘和人工无机粉尘。矿物性粉尘如石英，石棉，滑石，煤，稀土等；金属性粉尘如铅、锰、铁、铍等及其化合物；人工无机粉尘如金刚砂、水泥（C对ABDE错）、玻璃纤维等。